感邪后某一部位病症未了，又出现另一部位病证的发病类型是
A. 感而即发
B. 继发
C. 伏而后发
D. 复发
E. 并病

正确答案：E。并病

解析：并病是先后依次出现（E对）；感邪即发，又称为卒发、顿发，指机体感受病邪后，随即发病。（A错）；继发，指在原发疾病未愈的基础上继而发生新的疾病，继发病必以原发病为前提，二者取系密切（B错）；伏而后发，指感邪之后，邪藏体内，逾时而发的发病类型（C错）；复发，指疾病已愈，在病因或诱因的作用下，再次发病（D错）。